临床上最常见的骨折是
A. LeFortⅠ型骨折
B. LeFortⅡ型骨折
C. LeFortⅢ型骨折
D. 横断形、分离性骨折
E. 纵行骨折

正确答案：D。横断形、分离性骨折

解析：骨折线：上颌骨与鼻骨、颧骨和其他颅面骨相连，骨折线易发生在骨缝和薄弱的骨壁处，临床上最常见的是横断形、分离性骨折。掌握“牙槽突骨折、颌骨骨折”知识点。